下列仪器部件中，属于HPLC仪的有
A. 高压输液泵
B. 进样阀
C. 载气源
D. 检测器
E. 旋光计

正确答案：A、B、D。高压输液泵；进样阀；检测器

解析：本题考查高效液相色谱仪。高效液相色谱仪由高压输液泵（A对）、进样阀（B对）、色谱柱、检测器（D对）、积分仪或数据处理系统组成。